某地的一项关于男性膀胱癌与吸烟关系的大规模研究得出，吸烟者膀胱癌的发病率为48.0/100000，非吸烟者的膀胱癌的发病率为25.4/100000，根据以上资料，因吸烟所致的相对危险度为
A. 0.5
B. 0.6
C. 1.89
D. 32
E. 48

正确答案：C。1.89